无糖型颗粒剂制备时，宜加用的干燥粘合剂是
A. 糊精
B. β-环糊精
C. 淀粉
D. 药粉
E. 枸橼酸、碳酸钠

正确答案：C。淀粉